患者，女，60岁。双侧腮腺反复肿大十余年，有脂肪肝、糖尿病病史。一侧腮腺造影显示：腺实质内可见一腺泡充盈缺损，边缘光滑完整，分支导管受压移位；部分末梢导管呈球状扩张，主导管不均匀扩张。欲明确诊断，下一步首先需要进行的检查是
A. 追问病史，进行口腔及眼部症状、体征的检查
B. CT检查
C. B超检查
D. MRI检查
E. 核素显像

正确答案：A。追问病史，进行口腔及眼部症状、体征的检查

解析：从题干描述可以推断患者为舍格伦综合征，若明确诊断，应进一步询问口腔及眼部症状、体征的检查。掌握“舍格伦综合征”知识点。